用于导泻时硫酸镁的给药途径是
A. 静脉注射
B. 直肠给药
C. 皮内注射
D. 皮肤给药
E. 口服给药

正确答案：E。口服给药

解析：本题考查给药途径。用于导泻时硫酸镁的给药途径是口服给药（E对）。剂型可改变药物的作用性质：如硫酸镁口服（E对）剂型用作泻下药，但5%注射液静脉滴注，能抑制大脑中枢神经，具有镇静、解痉作用。